下列有关Kennedy第二类的设计中游离端侧缺牙两个以上者，说法不正确的是
A. 第二类为单侧游离缺失
B. 在游离端基牙上放置卡环
C. 用大连接体连到牙弓的对侧
D. 用小连接体连到牙弓的对侧
E. 在对侧牙弓上选两个基牙放置卡环

正确答案：D。用小连接体连到牙弓的对侧

解析：Kennedy第二类的设计要点：第二类缺失义齿的特点及设计要点均与第一类基本相同。不同点是第二类为单侧游离缺失，义齿不易平衡、稳定，必须双侧设计，在对侧设计间接固位体，用大连接体或鞍基连接，以分散（牙合）力，获得义齿的平衡、稳定和固位。游离端侧缺牙两个以上者，在游离端基牙上放置卡环，用大连接体连到牙弓的对侧，在对侧牙弓上选两个基牙放置卡环。掌握“局部义齿的设计”知识点。